停药后血浆中药物浓度已降至阈浓度以下时仍显现的药理作用称为
A. 耐受性
B. 后遗效应
C. 特异质反应
D. 副作用
E. 停药反应

正确答案：B。后遗效应

解析：后遗效应（B对）：停药后血浆中药物浓度已降至阈浓度以下时仍显现的药理作用。耐受性（A错）：机体在连续多次用药后对药物的反应性降低（P37）。特异质反应（C错）：少数特异体质患者对某些药物反应特别敏感。副作用（D错）：由于选择性低，药理效应涉及多个器官，当某一效应用作治疗目的时，其他效应就成为副反应（通常也称副作用）。停药反应（E错）：是指突然停药后原有疾病加剧，又称反跳反应。